公民临床用血时，交付费用的项目不包括的是
A. 采集血液费用
B. 检验血液费用
C. 分离血液费用
D. 储存血液费用
E. 购买血液费用

正确答案：E。购买血液费用

解析：根据《中华人民共和国献血法》规定，公民临床用血时，交付费用的项目包括：血站采集血液费用（A对）、分离血液费用（C对）、储存血液费用（D对）、检验血液费用（B对）及临床输血服务费等。《献血法》规定，无偿献血的血液必须用于临床，不得买卖，故临床用血交付费用不包括购买血液费用（E错，为本题正确答案）。